口腔内肿瘤的患者放射治疗前的准备不包括
A. 拔除口内的病灶牙
B. 治疗患龋的牙齿
C. 保留金属套冠及冠桥
D. 注意口腔卫生
E. 用氟剂涂布牙冠

正确答案：C。保留金属套冠及冠桥

解析：放射治疗前，应拔除口内病灶牙及肿瘤邻近的牙，拆除金属套冠及冠桥并治疗有龋患的牙齿。放射线的直接照射病灶同时，减少感染及颌骨坏死。注意口腔卫生，用氟剂涂布牙冠（包括用含氟牙膏）可在一定程度上预防放疗后猖獗龋的发生。掌握“口腔颌面部肿瘤的治疗原则及预防”知识点。